甲地区一年内发生肺癌患者100例，选取100例做吸烟与肺癌关系的调查，结果肺癌组吸烟者为80％，对照组中吸烟者为20％；在乙地区，调查了5万居民的吸烟状况，并观察了其经过，一年后吸烟者中有10例发生了肺癌，不吸烟者仅2例发生了肺癌。下列各项哪项是正确的
A. 甲地区的调查是相关性研究（生态学研究）
B. 甲地区的调查结果，肺癌组的吸烟率为对照组的4倍
C. 乙地区的调查是回顾性调查
D. 乙地区的调查结果，抽烟组的肺癌发生率为对照组的5倍
E. 甲、乙两地区调查均属观察性研究

正确答案：E。甲、乙两地区调查均属观察性研究

解析：本题考查流行病学研究方法。队列研究是将人群按是否暴露于某可疑因素及其暴露程度分为不同组，追踪其各组的结局，比较不同组之间结局频率的差异，从而判定暴露因素与结局之间有无因果关联及关联大小的一种观察性研究方法。病例对照研究是以当前已经确诊的患有某特定疾病的一组病人作为病例组，以不患有该病但具有可比性的一组个体作为对照组，通过询间、实验室检查或复查病史，搜集研究对象既往对各种可能的危险因素的暴露史，测量并采用统计学检验，比较病例组与对照组各因素暴露比例的差异是否具有统计学意义。本题甲地区是病例对照研究，乙地区是队列研究，二者均属于观察性研究（E对ABCD错）。